零售药店，凭盖有医疗单位公章的医师处方，可限量供应的品种有
A. 艾司唑仑片
B. 氨酚待因片
C. 司可巴比妥胶囊
D. 氯硝西泮片
E. 磷酸可待因片

正确答案：A、B、D。艾司唑仑片；氨酚待因片；氯硝西泮片